黏连性心包炎时心尖搏动
A. 呈负性心尖搏动
B. 向左下移位
C. 正常
D. 向上移位
E. 向下移位

正确答案：A。呈负性心尖搏动

解析：黏连性心包炎会对心脏的收缩功能、舒张功能受到限制，会出现代偿性改变，就会出现负性心尖搏动（A对C错）。心尖搏动向左下移位左心室肥大（B错）。肥胖体型者、小儿及妊娠时，横膈位置较高，使心脏呈横位，心尖搏动向上外移，可在第4肋间左锁骨中线外（D错）。若体型瘦长（特别是处于站立或坐位）使横膈下移，心脏呈垂位，心尖搏动移向内下，可达第6肋间（E错）。